13岁女孩，欲通过测体脂含量判断其肥胖程度。假设她的体脂占到体重的27%，则她属于
A. 不肥胖
B. 轻度肥胖
C. 中度肥胖
D. 重度肥胖
E. 极重度肥胖

正确答案：C。中度肥胖